白细胞计数减少、嗜酸性粒细胞消失，最可能的诊断是
A. 伤寒
B. 霍乱
C. 风湿
D. 细菌性痢疾
E. 结肠炎

正确答案：A。伤寒

解析：白细胞计数减少、嗜酸性粒细胞消失为伤寒（A对）的特殊临床表现之一，其血常规常表示为：外周血白细胞总数大多为（3～5）×10⁹/L，伴中性粒细胞减少及嗜酸性粒细胞减少或消失。霍乱（B错）的血常规白细胞可达10×l0⁹/L以上，中性粒细胞和单核细胞增多。风湿病（C错）的白细胞及其分类多在正常范围。细菌性痢疾（D错）时白细胞总数轻至中度增高，以中性粒细胞为主，可达（10～20）×10⁹/L。结肠炎（E错）常表现为白细胞总数增加。